某水体受生活污水及含大量有机物的工业废水的严重污染，已超过了水体的自净能力，水质已严重恶化，水中溶解氧含量几乎测不出，并已有变黑发臭的现象，此时水中进行的净化过程主要为
A. 物理净化过程
B. 化学净化过程
C. 光解和光氧化过程
D. 微生物的有氧分解过程
E. 微生物的厌氧分解过程

正确答案：E。微生物的厌氧分解过程

解析：本题考查微生物的厌氧分解过程。厌氧分解是指在没有氧气的情况下，微生物利用有机物作为氧源，将有机物分解成碳水化合物、氨和氢等，从而达到净化水体的目的。厌氧分解过程是一种有效的水体净化方法，它可以有效地去除水体中的有机物，从而改善水质。因此，在某水体受生活污水及含大量有机物的工业废水的严重污染，已超过了水体的自净能力，水质已严重恶化，水中溶解氧含量几乎测不出，并已有变黑发臭的现象的情况下，最佳的净化过程主要为微生物的厌氧分解过程（E对ABCD错）。